既息风止痉，又清热平肝的药是
A. 珍珠
B. 钩藤
C. 刺蒺藜
D. 珍珠母
E. 石决明

正确答案：B。钩藤

解析：本题考查钩藤的功效。既息风止痉，又清热平肝的药是钩藤（B对）。钩藤【功效】息风止痉，清热平肝。珍珠（A错）【功效】安神定惊，明目除翳，解毒敛疮，润肤祛斑。刺蒺藜（C错）【功效】平肝，疏肝，祛风明目，散风止痒。珍珠母（D错）【功效】平肝潜阳，清肝明目，安神定惊，收湿敛疮。石决明（E错）【功效】平肝潜阳，清肝明目。